以下哪些与青蒿素的情况相符合
A. 从植物青蒿中分离得到
B. 味甘甜，易溶于水
C. 遇碘化钾试液，析出碘
D. 可被氢氧化钠水溶液加热水解
E. 为高效、速效抗疟药

正确答案：A、C、D、E。从植物青蒿中分离得到；遇碘化钾试液，析出碘；可被氢氧化钠水溶液加热水解；为高效、速效抗疟药